某药物首过效应较大，适宜的剂型有
A. 肠溶剂
B. 舌下片
C. 泡腾片
D. 透皮贴剂
E. 注射剂

正确答案：B、D、E。舌下片；透皮贴剂；注射剂

解析：本题考查首过效应。避免首过效应，常采用舌下片（B对）、透皮贴剂（D对）和注射剂（E对）的方式给药；泡腾片（C错）和肠溶剂（A错）均属于口服给药制剂，易产生较大的首过效应。